临床场所提高不愿戒烟者戒烟动机的快速干预策略及措施为
A. 5A方案
B. 5W方案
C. 5B方案
D. 5S方案
E. 5R方案

正确答案：E。5R方案

解析：对于目前还不愿意戒烟的人而言，干预的目的是帮助他们提高戒烟的动机。临床场所提高不愿戒烟者戒烟动机的快速干预策略及措施可归纳为五个“R”（“5R’S”），即：Relevance（相关性）使患者认识到戒烟与他们密切相关；Risk（危险性）使患者认识到吸烟的潜在健康危害；Rewards（益处）使患者认识到戒烟的益处；Roadblocks（障碍）应该使患者认识到戒烟的过程中可能会遇到的障碍以及可以为他们提供的治疗手段；Repetition（反复）利用每次与患者接触或者沟通的机会，反复加强戒烟动机的干预，不断鼓励吸烟者积极尝试戒烟。掌握“干预基本模式及烟草行为干预”知识点。